汉防己长于
A. 利水消肿
B. 活血消肿
C. 利湿退黄
D. 祛风止痛
E. 息风止痉

正确答案：A。利水消肿

解析：本题考查的是防己的附注。汉防己长于利水消肿（A对）。防己：【来源】防己科植物粉防己的干燥根。习称汉防己。【附注】既往所用的防己还有木防己。木防已至少包括三个品种，即防己科的木防己、马兜铃科的汉中防己和广防己。传统认为，汉防己长于利水消肿，治水肿尿少宜用；木防己长于祛风止痛（D错），治风湿痹痛宜用。广防己因可引起肾脏损害，原国家食品药品监督管理局于2004年发布通知，取消广防己的药用标准。伸筋草：【功效】祛风除湿，舒筋通络，活血消肿（B错）。秦艽：【功效】祛风湿，舒筋络，清虚热，利湿退黄（C错）。钩藤：【功效】息风止痉（E错），清热平肝。